竞争性抑制作用的特点是
A. Km减小，Vmax减小
B. Km增大，Vmax增大
C. Km减小，Vmax增大
D. Km增大，Vmax不变
E. Km不变，Vmax减小

正确答案：D。Km增大，Vmax不变